前牙在正中（牙合）有早接触，前伸（牙合）协调，应磨改
A. 上牙牙尖
B. 下牙牙尖
C. 上牙舌面窝
D. 下牙唇面
E. 上牙舌斜面

正确答案：C。上牙舌面窝

解析：本题考查早接触点的选磨原则。选磨法即用砂石轮等磨改牙齿外形以消除创伤性（牙合）的方法。前牙在正中（牙合）有早接触，前伸（牙合）协调，说明仅有个别牙尖与舌窝或（牙合）窝在正中（牙合）时比其他牙齿先接触，而当牙尖循斜面滑行时，咬合协调 ，故此时不可磨改牙尖（AB错），以免导致垂直距离降低，只能磨改其相对应的舌窝或（牙合）窝的早接触区。在前牙应磨改上颌牙的舌窝（C对），后牙则磨改与牙尖相对应的（牙合）窝。若正中（牙合）协调，非正中（牙合）不协调，在前牙，应该磨改上颌牙的舌面（E错）或与上颌牙舌面相对应的下牙唇面。